患儿，6岁。证见发热，恶寒，无汗，鼻塞流涕，微咳，兼见脘腹胀满，呕吐酸腐，口气秽浊，大便酸臭，小便短黄，舌质红，苔厚腻，脉滑。其证候是
A. 感冒夹瘀
B. 感冒夹湿
C. 感冒夹惊
D. 感冒夹痰
E. 感冒夹滞

正确答案：E。感冒夹滞

解析：该题主要考查小儿感冒的辩证。感冒夹滞以肮腹胀满，不思饮食，大便不调，舌苔厚腻，脉滑为特征。食滞中焦则院腹胀满，不思饮食，呕吐，或见泄泻;食积化腐，浊气上升则口气秽浊，大便酸臭。该患儿，6岁。证见发热，恶寒，无汗，鼻塞流涕，微咳，兼见脘腹胀满，呕吐酸腐，口气秽浊，大便酸臭，小便短黄，舌质红，苔厚腻，脉滑。可判断为感冒夹滞（E对）。无感冒夹瘀之证型（A错）。无感冒夹湿之证型（B错）。感冒夹惊证候感冒兼见惊惕哭闹，睡卧不宁，甚至骤然抽风，舌质红，脉浮弦（C错）。感冒夹痰证候感冒兼见咳嗽较剧，痰多，喉间痰鸣（D错）。